SFDA警告不宜与头孢曲松混合的注射液有
A. 葡萄糖酸钙
B. 乳酸钠林格
C. 复方氯化钠
D. 10%葡萄糖
E. 葡萄糖氯化钠

正确答案：A、B、C。葡萄糖酸钙；乳酸钠林格；复方氯化钠

解析：本题考查药物的联合应用。葡萄糖酸钙（A对）、乳酸钠林格（B对）、复方氯化钠（C对）结构中具有羧酸钠和酰胺钠等阴离子基团，极易与钙离子形成不溶性沉淀，发生头孢曲松钙白色细微粒浑浊或沉淀，阻塞毛细血管，增加胆、肾、心、肺结石的危险性。10%葡萄糖（D错）、葡萄糖氯化钠（E错）中无钙，不会影响疗效。